患者，女，20岁。近1个月来发现右上前牙唇侧有膨隆，无明显疼痛。3年前有过外伤史，未经治疗。检查：牙冠色泽变暗、Ⅰ度松动、叩痛不明显；扪诊唇侧乒乓球感、无波动感；牙髓活力测定无反应。首选的诊断是
A. 牙槽脓肿
B. 牙源性角化囊性瘤
C. 根尖周炎
D. 根尖周囊肿
E. 牙瘤

正确答案：D。根尖周囊肿

解析：本题考查根尖周囊肿的诊断。患者女，近1个月来发现右上前牙唇侧有膨隆（有肿物），无明显疼痛。3年前有过外伤史，未经治疗。检查：牙冠色泽变暗（死髓牙）、Ⅰ度松动、叩痛不明显；扪诊唇侧乒乓球感、无波动感（根尖周囊肿）；牙髓活力测定无反应（死髓牙）。首选诊断为根尖周囊肿（D对）。根尖周囊肿的大小不定，可由豌豆大到鸡蛋大。小囊肿在牙龈表面多无异常表现，囊肿发展较大时，可见患牙根尖部的牙龈处呈半球状隆起，不红，双指交替按压扪诊时有兵乓球的弹性手感。囊肿过分增大时，因周围骨质吸收并压迫邻牙，造成邻牙移位或使邻牙牙根吸收。牙槽脓肿（A错）不会有扪诊乒乓球感的表现且多由牙源性龋病引起。牙源性角化囊性瘤（B错）一般发生于磨牙区或下颌升支部，根尖周炎（C错）和牙瘤（E错）为干扰选项，不符合临床表现，故应诊断为根尖周囊肿。